LD₅₀与毒性评价的关系是
A. LD₅₀值与毒性大小成正比
B. LD₅₀值与急性阈剂量成反比
C. LD₅₀值与毒性大小成反比
D. LD₅₀值与染毒剂量成正比

正确答案：C。LD₅₀值与毒性大小成反比

解析：本题考查LD₅₀与毒性评价的关系。LD₅₀即半数致死剂量，指引起一组受试实验动物半数死亡的剂量或浓度。LD₅₀值与毒性大小成反比（C对ABD错），LD₅₀数值越小，表示外源化学物的毒性越强；反之LD₅₀数值越大，则毒性越低。